免疫性胃炎导致的大细胞贫血，应补充哪种营养
A. VitB12
B. 叶酸
C. 维生素C
D. 铁离子
E. 维生素B

正确答案：A。VitB12

解析：免疫性胃炎胃体腺壁细胞可分泌内因子，它能与食物中的维生素B12结合，当出现大细胞贫血时，说明体内出现了针对壁细胞或内因子的自身抗体，内因子减少可导致维生素B12吸收不良，此时应补充VitB12（A对）。